某女性患者，35岁。有甲状腺功能亢进病史，经内科治疗好转，近日因感冒出现心慌、胸闷、不安、睡眠差，心电图显示：窦性行动过速。据此病人应选用的抗心律失常药为
A. 利多卡因
B. 苯妥英钠
C. 普萘洛尔
D. 维拉帕米
E. 普罗帕酮

正确答案：C。普萘洛尔

解析：本题考查甲状腺毒症心脏病的治疗。35岁女患有甲状腺功能亢进病史，经内科治疗好转，近日因感冒出现心慌、胸闷、不安、睡眠差，心电图显示：窦性行动过速（符合甲状腺毒症心脏病临床表现及体征）。据此病人应选用的抗心律失常药为普萘洛尔（C对）。利多卡因（A错）的适应证：血流动力学稳定的室性心动过速及心室颤动/无脉室性心动过速（但均不作为首选）。维拉帕米（D错）的适应证：各种折返性室上性心动过速，预激综合征利用房室结作为通道的房室折返性心动过速；心房扑动与颤动时减慢心室率；某些特殊类型室速。普罗帕酮（E错）的适应证：各种类型室上性心动过速；室性期前收缩，难治性、致命性室速。